外周血管痉挛性疾病可用何药治疗
A. 酚妥拉明
B. 东莨菪碱
C. 阿托品
D. 普奈洛尔
E. 多巴酚丁胺

正确答案：A。酚妥拉明